在配制液体制剂时，为了增加难溶性药物的溶解度，通常需要在溶剂中加入第三种物质，与难溶性药物形成可溶性的分子间络合物、缔合物和复盐等。加入的第三种物质属于
A. 助溶剂
B. 潜溶剂
C. 增溶剂
D. 助悬剂
E. 乳化剂

正确答案：A。助溶剂

解析：本题考查液体制剂常用的附加剂的作用。助溶剂（A对）是指在配制液体制剂时，为了增加难溶性药物的溶解度，通常需要在溶剂中加入的第三种物质，与难溶性药物形成可溶性的分子间络合物、缔合物和复盐等；潜溶剂（B错）系指能形成氢键以增加难溶性药物溶解度的混合溶剂；增溶剂（C错）为具有增溶能力的表面活性剂；助悬剂（D错）是指能增加混悬剂中分散介质的黏度，降低药物微粒的沉降速度或增加微粒亲水性的附加剂；乳化剂（E错）是乳剂制备中能够使分散相乳化并保持稳定的物质。